妊娠合并糖尿病有何临床表现
A. 出现多饮、多食、多尿三多症状
B. 外阴阴道假丝酵母菌感染反复发作
C. 孕妇体重＞90kg
D. 并发羊水过多或巨大胎儿
E. 以上全是

正确答案：E。以上全是